药品通用名称不得
A. 作为药品商标使用
B. 与药品商品名称同时使用
C. 由企业使用
D. 作为药品法定名称
E. 列入国家药品标准

正确答案：A。作为药品商标使用

解析：本题考查通用名称。药品通用名称不得作为药品商标使用（A对）。药品通用名称与药品商品名称可以同时使用（B错）。药品通用名称可由企业使用（C错）。药品通用名称作为药品法定名称（D错）。列入国家药品标准（E错）的药品名称为药品通用名称。